下列有关复合树脂修复的适应证、禁忌证的叙述中，错误的是
A. 可用作牙周夹板
B. 磨牙症患者可用复合树脂进行修复
C. 可用作窝沟封闭
D. 可用作冠修复中核的构建
E. 能否成功隔离是临床上使用树脂粘接修复关键

正确答案：B。磨牙症患者可用复合树脂进行修复

解析：复合树脂修复的适应证与禁忌证适应证：复合树脂可用于临床上大部分的牙体缺损修复，其广义适应证包括：①Ⅰ～Ⅴ类窝洞的修复；②冠修复中核的构建；③窝沟封闭；④美容性修复，如贴面、牙外形修整、牙间隙封闭；⑤间接修复体的粘固；⑥暂时性修复体；⑦牙周夹板。禁忌证：复合树脂修复的禁忌证与隔离和咬合等因素有关，即：①如果不能有效隔离治疗区者；②如果所有的咬合都位于修复体上时；③深度磨耗或磨牙症患者；④修复体延伸到根面时。掌握“树脂修复适应证、禁忌证与基本步骤”知识点。